18岁女学生，骑自行车与三轮车相撞，自觉外阴疼痛难忍并肿胀就诊。根据女性外阴解剖学特点，可能发生的是
A. 小阴唇致伤
B. 处女膜破裂
C. 大阴唇血肿
D. 阴道前庭损伤
E. 前庭大腺肿大伴出血

正确答案：C。大阴唇血肿

解析：大阴唇皮下为疏松结缔组织和脂肪组织，含丰富血管、淋巴管、神经，外伤后易形成血肿（C对）。小阴唇（A错）位于大阴唇内侧；阴道前庭（D错）为一菱形区域，前为阴蒂，后为阴唇系带，两侧为小阴唇，受大阴唇保护；前庭大腺（E错）位于大阴唇后部，被球海绵体覆盖，外伤均不易伤及（P005）。处女膜（B错）是阴道口周缘覆有的一层较薄的黏膜皱襞，常因性交撕裂或剧烈运动破裂（P005）。